某研究者在社区进行糖尿病患病率调查时，首先将全区的人群按经济条件分为好、较好、差三类，然后每一类各随机抽取1/100的人做调查。该研究者使用的抽样方法分别是
A. 整群抽样，机械抽样
B. 系统抽样，单纯随机抽样
C. 机械抽样，分层抽样
D. 分层抽样，单纯随机抽样
E. 单纯随机抽样，系统抽样

正确答案：D。分层抽样，单纯随机抽样

解析：整群抽样是抽取的群的全部观察单位组成样本。系统抽样是将总体的观察单位按顺序分成n个部分，再从第一部分里抽取第k号，依次用相等间隔，从每一部分各抽取一个观察单位组成样本。分层抽样是先按照对主要研究指标影响较大的某种特征，将总体分为若干类别，再从每一层内随机抽取一定数量的观察单位组成样本。单纯随机抽样是简单随机抽样，按等概率原则直接从含有N个观察单位的总体中抽取n个观察单位组成样本。题目按照经济条件分类即分层抽样，同时按照1/100的概率随机抽样即为单纯随机抽样。依据题意，符合分层+随机抽样（D对）。